男，45岁。1天前进食较硬食物后突发呕血1次，约400ml，排黑色糊状便2次，每次量约200g，无腹痛。既往乙型肝炎病史14年，1年前发生类似呕血1次。查体：BP105/65mmHg。皮肤巩膜无黄染，腹软，无压痛，肝肋下未触及，脾肋下2cm，移动性浊音阴性，肠鸣音4～5次/分。实验室检查：Hb95g/L，WBC2.5×10⁹/L，plt47×10⁹/L。首先考虑的出血原因是
A. 急性糜烂出血性胃炎
B. 胃癌
C. 胃溃疡
D. 贲门黏膜撕裂
E. 食管胃底静脉曲张破裂

正确答案：E。食管胃底静脉曲张破裂

解析：中年男性患者，既往乙型肝炎病史14年（肝硬化的高危因素），1天前进食较硬食物后（食管胃底静脉曲张出血的常见诱因）突发呕血1次，约400ml，排黑色糊状便2次，每次约200g（上消化道出血的表现）。查体：脾肋下2cm（脾肿大）。实验室检查：Hb95g/L（正常值为120～160g/L，提示有贫血），WBC2.5×10⁹ （正常值为4～10×10⁹/L，提示白细胞减少），plt47×10⁹ （正常值为100～300×10⁹/L，提示血小板减少），考虑为脾肿大、脾功能亢进所致。综合患者的病史、临床表现、查体和实验室检查，可初步诊断为肝炎后肝硬化伴食管胃底静脉曲张破裂（E对）。急性糜烂性出血性胃炎（P353）（A错）大多是在胃炎基础上有服用非甾体类消炎镇痛药、酗酒及烧伤、大手术、颅脑外伤史等，多表现为上腹部的隐痛或剧痛，伴恶心等症状；胃癌（P365）（B错）常有多年胃溃疡病史，有发热、乏力、消瘦等全身症状；胃溃疡（P359）（D错）多表现为有一定周期性与节律性的上腹痛，一般很少发生上消化道大出血；贲门黏膜撕裂（P450）（D错）可出现大量呕血，但常发生在剧烈呕吐后，且以上疾病均不会出现脾大、脾功能亢进表现。